“生痰之源”是指
A. 脾
B. 胃
C. 肾
D. 肝
E. 肺

正确答案：A。脾

解析：本题考查肺脾的相互关系，属于理解记忆内容。肺脾两脏协调配合，相互为用，是保证津液正常输布与排泄的重要环节。若脾失健运，水液不化，聚湿生痰，为饮为肿，影响及肺则失其宣降而痰嗽喘咳。是病其标在肺，而其本在脾，故有“脾为生痰之源，肺为贮痰之器”之说（A对）。